上颌骨的发育来源于
A. 第1鳃弓
B. 第2鳃弓
C. 第3鳃弓
D. 第4鳃弓
E. 第5鳃弓

正确答案：A。第1鳃弓

解析：上颌骨发育自第1鳃弓。掌握“唾液腺与颌骨的发育”知识点。